临床试验中的双盲法是指
A. 被观察者不知道分组情况和接受的治疗措施
B. 观察者不知道分组情况和接受的治疗措施
C. 被观察者与分析者均不知道分组情况和接受的治疗措施
D. 观察者与被观察者均不知道分组情况和接受的治疗措施
E. 观察者与分析者均不知道分组情况和接受的治疗措施

正确答案：D。观察者与被观察者均不知道分组情况和接受的治疗措施

解析：根据题意，考察临床试验中双盲法的概念。双盲法是，研究对象和观察者都不知道分组情况，也不知道研究对象接受的处理措施。概念涉及研究对象（被观察者）和观察者（ D对）。